控制癫痫复杂部分发作最有效的药物是
A. 苯巴比妥
B. 卡马西平
C. 丙戊酸钠
D. 硝西泮
E. 苯妥英钠

正确答案：B。卡马西平